男，28岁。车祸后胸痛、呼吸困难40分钟。曾咳出少量血痰，无恶心、呕吐，无腹胀、腹痛，无意识障碍。查体：P118次/分，R22次/分，BP90/60mmHg。气管右偏，左侧胸壁皮肤淤青，无皮下气肿，左侧4、5、7肋骨触痛明显，可触及骨擦感，左胸叩诊鼓音，呼吸音减弱，心律齐，未闻及心脏杂音。腹软，无压痛，肝脾肋下未触及。四肢活动尚可，病理反射未引出。辅助检查:Hb100g/L，RBC3.2×l0¹²/L.胸部X线片示左侧4、5、7肋骨折，左侧气胸，肺组织压缩约70%，左侧胸腔中等量积液。根据患者目前病情推断，最有可能合并存在的情况是
A. 连枷胸
B. 张力性气胸
C. 创伤性窒息
D. 脓胸
E. 肺裂伤

正确答案：A。连枷胸

解析：成年男性患者，有车祸受伤史，胸痛、呼吸困难，胸部X线片示左侧4、5、7肋骨折（A对），左侧气胸，肺裂伤（E错）多有爆炸现场接触史和咯血的症状，该患者出现血痰的表现，故为肺裂伤。左侧胸壁皮肤淤青，无皮下气肿可排除张力性气胸（B错）。创伤性窒息（C错）多表现为面、颈、上胸部皮肤出现针尖大小的紫蓝色淤斑，以面部与眼眶部为明显。脓胸（D错）患者常有发热等全身反应，且有致病菌及感染过程。